在天然的苷类中，多形成β-苷键构型的糖苷是
A. D-葡萄糖苷
B. L-鼠李糖苷
C. D-半乳糖苷
D. D-木糖苷
E. L-阿拉伯糖苷

正确答案：A、C、D。D-葡萄糖苷；D-半乳糖苷；D-木糖苷

解析：本题考查的是苷类的分类。在天然的苷类中，多形成β-苷键构型的糖苷是D-葡萄糖苷（A对）、D-半乳糖苷（C对）与D-木糖苷（D对）。苷类有α-苷和β-苷之分。在天然的苷类中，由D型糖衍生而成的苷，多为β-苷（例如β-D-葡萄糖苷），而由L型糖（BE错）衍生的苷，多为α-苷（例如α-L鼠李糖苷）。